具有理气、调中、燥湿、化痰功效的药物是
A. 陈皮
B. 青皮
C. 枳实
D. 木香
E. 香附

正确答案：A。陈皮

解析：该题考查理气药的功效，属记忆内容。橘皮（陈皮）味辛、苦，性温；归脾、肺经；具有理气，调中，燥湿，化痰的功效（A对BCDE错）。